下列哪些不属于咽淋巴环的组成
A. 咽扁桃体
B. 腭扁桃体
C. 舌扁桃体
D. 咽鼓管扁桃体
E. 集合淋巴滤泡

正确答案：E。集合淋巴滤泡

解析：咽扁桃体(A对)、腭扁桃体(B对)、舌扁桃体(C对)和咽鼓管扁桃体(D对)共同组成咽淋巴环，集合淋巴滤泡(E错，为本题正确答案)多位于回肠下部。